白芍的主治病证是
A. 跌打损伤
B. 阴虚燥咳
C. 癥瘕痞块
D. 疮肿瘰疬
E. 四肢拘急作痛

正确答案：E。四肢拘急作痛

解析：本题考查的是白芍的主治病证。白芍的主治病证是四肢拘急作痛（E对）。白芍：【主治病证】（1）血虚萎黄，月经不调，痛经，崩漏。（2）阴虚盗汗，表虚自汗。（3）肝脾不和之胸胁脘腹疼痛，或四肢拘急作痛。（4）肝阳上亢之头痛眩晕。当归：【主治病证】（1）血虚萎黄、眩晕心悸。（2）月经不调，闭经，痛经。（3）虚寒腹痛，瘀血作痛，跌打损伤（A错），痹痛麻木。（4）痈疽疮疡。（5）血虚肠燥便秘。阿胶：【主治病证】（1）血虚眩晕、心悸。（2）吐血，衄血，便血，崩漏，妊娠胎漏。（3）阴虚燥咳（B错）或虚劳喘咳。（4）阴虚心烦、失眠。郁金：【主治病证】（1）胸腹胁肋胀痛或刺痛，月经不调，痛经，癥瘕痞块（C错）。（2）热病神昏，癫痫发狂。（3）血热之吐血、衄血、尿血，妇女倒经。（4）湿热黄疸，肝胆或泌尿系结石症。何首乌：【主治病证】（1）精血不足之头晕眼花、须发早白、腰酸脚软、遗精、崩漏、带下。（2）疮肿，瘰疬（D错）。（3）体虚久疟。（4）肠燥便秘。